治疗肺热壅盛，喘促气急，宜与平喘药配伍使用的是
A. 栀子
B. 芦根
C. 石膏
D. 夏枯草
E. 淡竹叶

正确答案：C。石膏

解析：肺热壅盛，喘促气急，治疗除需要平喘之外，还应治疗肺热，配伍辛寒清泄肺经实热之石膏最宜（C对）。栀子（A错）的功效是泻火除烦，清热利尿，凉血解毒。外用消肿止痛。焦栀子是凉血止血。芦根（B错）的功效是清热泻火，生津止渴，除烦，止呕，利尿。夏枯草（D错）的功效是清热泻火，明目，散结消肿。淡竹叶（E错）的功效是清热泻火，除烦止渴，利尿通淋。